制备溶胶剂可选用的方法有
A. 机械分散法
B. 微波分散法
C. 超声分散法
D. 物理凝聚法
E. 化学凝聚法

正确答案：A、C、D、E。机械分散法；超声分散法；物理凝聚法；化学凝聚法